当今医患关系法制化趋势反映在
A. 将部分医德规范观念纳入《中华人民共和国执业医师法》
B. 医患交往中“人患者-机仪器-人医务人员”的现象越来越普遍
C. 患者自主选择医生护士医疗手术小组的做法被推广
D. 医患交往的社会性日益突出，也日益为社会关注
E. 医患交往的经济条件文化背景日显重要

正确答案：A。将部分医德规范观念纳入《中华人民共和国执业医师法》

解析：当今医患关系法制化趋势反映在，将部分医德规范观念纳入《中华人民共和国执业医师法》。《中华人民共和国执业医师法》以法律的形式规定了医师的相应的权利（A对）。